急性链球菌感染后肾小球肾炎电镜下的典型表现是
A. 广泛足突消失
B. 电子致密物呈“飘带”样在肾小球基底膜沉积
C. 毛细血管腔内中性粒细胞浸润
D. 电子致密物呈“驼峰”样在上皮下沉积
E. 电子致密物在系膜区沉积

正确答案：D。电子致密物呈“驼峰”样在上皮下沉积

解析：急性链球菌感染后肾小球肾炎多为急性肾小球肾炎，其特征性镜下表现为电子致密物呈“驼峰”样在上皮下沉积 （D对）。广泛足突消失（A错）为微小病变型肾病的主要表现。电子致密物呈“飘带”样在肾小球基底膜沉积（B错）为I型急进性肾炎的免疫学表现。急性炎症时可有毛细血管腔内中性粒细胞浸润（C错），无特异性。系膜区电子致密物沉积（E错）可见于Ⅱ型急进性肾炎。